必需脂肪酸与非必需脂肪酸的区别是
A. 前者不能在人体内消化，而后者可以
B. 后者不能在人体内消化，而前者可以
C. 所含氮元素的量不一样
D. 后者不能在人体合成，而前者可以
E. 前者不能在人体合成，而后者可以

正确答案：E。前者不能在人体合成，而后者可以

解析：必需脂肪酸与非必需脂肪酸的区别是前者不能在人体合成，而后者可以（E对）。亚麻酸、α-亚油酸及花生四烯酸为人体的必需脂肪酸，不能由人体合成，只能从食物中获得。其他脂肪酸称为非必需脂肪酸，可以在体内合成。